女，25岁，颊黏膜处有一蓝紫色的包块，质软，可被压缩。镜下可见瘤组织由衬有内皮细胞的血窦组成，其间可见菲薄的结缔组织间隔。病理诊断为
A. 蔓状血管瘤
B. 毛细血管瘤
C. 肉芽组织性血管瘤
D. 海绵状血管瘤
E. 血管性龈瘤

正确答案：D。海绵状血管瘤

解析：本题考查静脉畸形。静脉畸形即海绵状血管瘤（D对），是由衬有内皮细胞的无数血窦所组成，好发于颊、颈、眼睑、唇、舌或口底部，表浅病损呈现蓝色或紫色。蔓状血管瘤（A错）即动静脉畸形，病损高起呈念珠状，表面皮肤温度较高，扪诊有震颤感，听诊有吹风样杂音。毛细血管瘤（B错）即微静脉畸形，组织病理特点是肿瘤内富含增生活跃的血管内皮细胞，并有成血管现象和肥大细胞聚集。肉芽组织性血管瘤（C错）即分叶状毛细胞血管瘤，组织学上类似于婴儿血管瘤。由增生的内皮细胞构成的小叶组成，小叶内常含较小的、多少不一的血管腔隙，不符合题意。血管性龈瘤（E错）的特点为血管内皮细胞增生呈实性片块或条索，也可是小血管或大的薄壁血管增多，不符合题意。